病人安于已适应的角色，小病大养，该出院而不愿意出院，此时病人的状态被称为角色行为
A. 减退
B. 缺如
C. 冲突
D. 强化
E. 异常

正确答案：D。强化